当静脉滴注时间过长、浓度过高造成局部缺血坏死，可用普鲁卡因或酚妥拉明做局部浸润注射，以扩张血管的药物是
A. 肾上腺素
B. 多巴胺
C. 异丙肾上腺素
D. 去甲肾上腺素
E. 卡马西平

正确答案：D。去甲肾上腺素

解析：去甲肾上腺素的不良反应可引起局部组织坏死。静脉滴注过长、浓度过高或药液漏出血管，可引起局部缺血坏死，如发现外漏或注射部位苍白，应停止注射或更换注射部位，进行热敷，并用普鲁卡因或α受体阻断剂酚妥拉明做局部浸润注射，以扩张血管。掌握“去甲肾上腺素”知识点。